外阴阴道病念珠菌传染主要途径
A. 间接性
B. 内源性
C. 血液
D. 垂直
E. 性生活

正确答案：B。内源性

解析：外阴阴道病念珠菌又称假丝酵母菌，其主要传播途径为内源性（B对）传染。假丝酵母菌除作为条件致病菌寄生阴道外，也可寄生于人的口腔、肠道，一旦条件适宜，这3个部位的假丝酵母菌可互相传染，称为内源性传染。少部分患者可通过性生活（E错）直接传染，极少通过接触感染的衣物间接性（A错）传染，不能通过血液（C错）和垂直传播（D错）。